（）急性中毒时，可出现肾小管坏死性急性肾衰竭
A. 四氯化碳
B. 三氯乙烯
C. 二氯甲烷
D. 二硫化碳

正确答案：A。四氯化碳

解析：本题考查诱发肾小管坏死性急性肾衰竭的毒物。有机溶剂的急性或慢性接触常常对肾脏会产生诸多不良影响。当机体四氯化碳（A对BCD错）急性中毒时，常出现肾小管坏死性急性肾衰竭。多种溶剂或混合溶剂慢性接触可致肾小管性功能不全，出现蛋白尿、尿酶尿。溶剂接触还可能与原发性肾小球性肾炎有关。